某厂某年20～24岁年龄组工人死亡总数为500人，其中因肺结核死亡50人，全人口中该年20～24岁结核病死亡占全死因死亡的比例为5％，那么SPMR为
A. 2
B. 5
C. 2.5
D. 4
E. 1

正确答案：A。2